成人淋病主要传播方式是
A. 血液传播
B. 唾液传播
C. 乳汁传播
D. 皮肤接触
E. 性传播

正确答案：E。性传播

解析：人类是淋病奈瑟菌唯一宿主，成人淋病主要经性接触传播。患有淋病的妊娠母亲生产时，新生儿易感染引起淋球菌性结膜炎。掌握“肠球菌属及奈瑟菌属”知识点。